tRNA反密码子第1位碱基Ⅰ可与mR-NA上密码子第3位碱基U，C或A配对，属于密码的
A. 连续性
B. 特异性
C. 通用性
D. 摆动性
E. 简并性

正确答案：D。摆动性

解析：本题考查遗传密码的特点。tRNA反密码子第1位碱基Ⅰ可与mRNA上密码子第3位碱基U，C或A配对，属于密码的摆动性（D对）。遗传密码的特点包括方向性、连续性、简并性、摆动性、通用性，不包括特异性（B错）。连续性（A错）是指mRNA的密码子之间没有间隔核苷酸，从起始密码子开始，密码子被连续阅读直至终止密码子出现。通用性（C错）是指从细菌到人类都使用着同一套遗传密码。简并性（E错）是指有的氨基酸可有多个密码子编码。